骨肉瘤最重要的组织学特点是
A. 细胞核多形
B. 血管内瘤栓
C. 肿瘤性成骨
D. 细胞异型性明显
E. 核分裂象多见

正确答案：C。肿瘤性成骨

解析：骨肉瘤为最常见的骨恶性肿瘤。镜下，肿瘤细胞异型性明显，梭形或多边形，直接形成肿瘤性骨样组织或骨组织（C对），这是诊断骨肉瘤最重要的组织学依据。